患者，女，29岁。结婚4年未孕，月经周期不规律，经来腹痛，月经量少，色暗有小血块，经前乳胀，烦躁易怒，舌红，苔白，脉弦。治疗应首选的方剂是
A. 启官丸
B. 养精种玉汤
C. 开郁种玉汤
D. 柴胡疏肝散
E. 逍遥散

正确答案：C。开郁种玉汤

解析：患者"结婚4年未孕"可辨病为不孕证，根据"月经周期不规律，经来腹痛，月经量少，色暗有小血块，经前乳胀，烦躁易怒，舌红，苔白，脉弦"可辨证为肝气郁结证；治宜疏肝解郁，养血理脾；方选开郁种玉汤（C对）。启宫丸用于治疗痰湿壅阻之不孕症（A错）。养精种玉汤合清骨滋肾汤用于治疗肾阴虚之不孕症（B错）。柴胡疏肝散为理气剂，具有疏肝理气，活血止痛之功效。主治肝气郁滞证。胁肋疼痛，胸闷善太息，情志抑郁易怒，或嗳气，脘腹胀满，脉弦。临床常用于治疗慢性肝炎、慢性胃炎、肋间神经痛等属肝郁气滞者（D错）。逍遥散为和解剂，具有调和肝脾，疏肝解郁，养血健脾之功效。主治肝郁血虚脾弱证。两胁作痛，头痛目眩，口燥咽干，神疲食少，或月经不调，乳房胀痛，脉弦而虚者。临床常用于治疗慢性肝炎、肝硬化、胆石症、胃及十二指肠溃疡、慢性胃炎、胃肠神经官能症、经前期紧张症、乳腺小叶增生等属肝郁血虚脾弱者（E错）。